X线片根尖周透射区包括多个未治疗牙时确诊病源牙的主要依据是患牙
A. 有无龋洞
B. 是否有牙周疾病
C. 牙髓有无活力
D. 有无窦道
E. 有无叩痛

正确答案：C。牙髓有无活力

解析：根尖周透射区代表根尖周的慢性炎症性疾病，通常患牙的牙髓活力已经丧失。只有牙髓坏死，炎性物质波及根尖周，才出现根尖周的病变。掌握“慢性根尖周炎”知识点。